适用于乳漏疮口漏乳不止，脓腐已脱尽后的外治法是
A. 腐蚀法
B. 垫棉法
C. 切开法
D. 挂线法
E. 结扎法

正确答案：B。垫棉法

解析：腐蚀法治疗乳漏，先用提脓去腐药，脓尽后改用生肌药，使创面从基底部长起，适用于脓未溃及破溃后引流不畅（A错）。垫棉法适用于乳漏疮口漏乳不止及乳房部漏脓腐脱尽后，以促进疮口愈合（B对）。切开法适用于浅层漏管及腐蚀法失败者（C错）。挂线法适用于深层漏管（D错）。结扎法适用于瘤、赘疣、痔、脱疽等病，以及脉络断裂引起的出血之症（E错）。